因颈部运动而加重的是
A. 丛集性头痛
B. 腰椎穿刺后头痛
C. 颈肌急性炎症
D. 神经官能症
E. 脑肿瘤

正确答案：C。颈肌急性炎症

解析：因颈部运动而加重的是颈肌急性炎症（C对）。丛集性头痛在站位可缓解（A错）。腰椎穿刺后的头痛在直立位时加重（B错）。神经性头痛因精神紧张、失眠等诱发（D错）。如咳嗽、转头、俯首等使颅内压增高的动作，常使脑肿瘤、脑膜炎及血管性头痛加剧（E错）。